下列情况不适宜用无创正压通气处置的是
A. 急性呼吸窘迫综合征
B. 慢性阻塞性肺疾病急性加重
C. 昏迷
D. 心源性肺水肿
E. 有创机械通气的序贯治疗

正确答案：C。昏迷

解析：当机体出现严重的通气和（或）换气功能障碍时，以人工辅助通气装置（有创或无创正压呼吸机）来改善通气和（或）换气功能，即为正压机械通气。无创正压通气可以用于治疗急性呼吸窘迫综合征（A对），在慢阻肺急性加重早期（B对）、慢阻肺有创－无创序贯通气（E对）、急性心源性肺水肿（D对）、免疫力低下病人、术后预防呼吸衰竭以及家庭康复等方面均有良好的治疗效果（P144）。